修复Kennedy第一类、第二类缺损的主要难点是
A. 防止义齿对基牙的损伤
B. 防止义齿对牙槽嵴的损伤
C. 防止义齿沿支点线旋转
D. 防止义齿（牙合）向移位
E. 防止义齿龈向移位

正确答案：C。防止义齿沿支点线旋转

解析：本题考查修复Kennedy第一类、第二类缺损的难点。修复Kennedy第一类、第二类缺损的主要难点是防止义齿沿支点线旋转（C对）。Kennedy第一类牙列缺损的义齿由天然牙与黏膜混合支持，多为Cummer分类的横线式或斜线式；Kennedy第二类牙列缺损的义齿由天然牙与黏膜混合支持，多个后牙缺失的修复常设计成Cummer分类的斜线式，单个后牙缺失修复则多为纵线式。可摘局部义齿的Cummer分类：第一类：支点线斜割牙弓，即斜线式。第二类：支点线横割牙弓，即横线式。第三类：支点线位于牙弓的一侧而呈前后方向者，即纵线式。第四类：支点线构成多边形，即平面式。Cummer分类除平面式以外的其他三类义齿，其支托连线形成转动轴，在力不平衡的情况下易使义齿形成绕转动轴的转动。